关于下运动神经元损伤后的症状，哪项是错误的
A. 肌逐渐萎缩
B. 腱反射消失
C. 肌弛缓性瘫痪
D. 躯体感觉和内脏感觉正常
E. Babinski征阳性

正确答案：E。Babinski征阳性

解析：下运动神经元损伤表现为肌肉失去神经直接支配，其特点为：①随意运动障碍；②肌张力降低，即肌弛缓性瘫痪（C对），因肌肉出现神经营养障碍，还可导致肌逐渐萎缩（A对）；③浅反射和深反射如腱反射都消失（B对）；④病理反射阴性（E错，为本题正确答案）。下运动神经元损伤导致的是肌肉运动障碍，和躯体、内脏感觉传导无关，因而.躯体感觉和内脏感觉正常（D对）。